内分泌系统叙述错误的是
A. 与神经系统相辅相成
B. 淋巴器官兼有内分泌功能
C. 分泌物称为激素
D. 激素直接进入淋巴管
E. 内分泌腺的体积较小

正确答案：D。激素直接进入淋巴管

解析：内分泌系统是机体的调节系统，与神经系统相辅相成（A对），共同维持机体内环境的平衡与稳定。淋巴器官，如胸腺，兼有内分泌功能（B对）。内分泌腺的体积较小（E对），分泌的物质称为激素（C对），激素直接进入血液循环，并不会直接进入淋巴管(D错，为本题正确答案)。